某男，43岁。吸烟10年，每天一包，不想戒烟。他说：我从不生病，即使吸烟也不会得肺癌。针对该患者的想法，应首先向他指出的
A. 吸烟相关疾病的易感性
B. 行为改变的有效性
C. 行为改变的障碍
D. 吸烟相关疾病的严重性
E. 自我效能的重要性

正确答案：A。吸烟相关疾病的易感性

解析：行为转变理论模式，也称为行为阶段转变理论模型（TTM） ，它着眼于行为变化过程及对象需求，理论基础是社会心理学。它认为人的行为转变是一个复杂、渐进、连续的过程，可分为5个不同的阶段，即没有准备阶段、犹豫不决阶段、准备阶段、行动阶段和维持阶段。在没有准备阶段，患者对问题尚无了解，没有形成意图，因此应该采取的措施是，提供信息，提高认识，使患者形成解决问题的意图，从而促使行为改变。题中男性并没有意识到吸烟的危害，仍然处于没有准备阶段，应向他指出吸烟相关疾病的易感性（A对），使患者产生戒烟意图，从而引起患者的行为转变。